肺泡内压在下列哪一呼吸时相中与大气压相等
A. 呼气初与呼气末
B. 吸气初与吸气末
C. 吸气初与呼气末
D. 吸气末与呼气末
E. 吸气初与呼气初

正确答案：D。吸气末与呼气末